发生在舌下腺的肿瘤多为
A. 腺泡细胞癌
B. 沃辛瘤
C. 腺样囊性癌
D. 多形性腺瘤
E. 黏液表皮样癌

正确答案：C。腺样囊性癌

解析：本题考查腺样囊性癌。在唾液腺的不同解剖部位中，腮腺肿瘤的发生率最高约80％，下颌下腺肿瘤占10％，舌下腺肿瘤占1％，小唾液腺肿瘤占9％。并且不同组织类型的肿瘤在各个部位的唾液腺中发生的相对比例也不一样。舌下腺肿瘤很少见，但一旦发生，多为腺样囊性癌（C对）。沃辛瘤（B错）、嗜酸性粒细胞腺瘤几乎仅发生于腮腺；腺泡细胞癌（A错）、多形性腺瘤（D错）唾液腺导管癌、上皮-肌上皮癌多见于腮腺；多形性低度恶性腺癌多见于腭部小唾液腺；管状腺瘤90％发生于唇腺。磨牙后区腺源性肿瘤以黏液表皮样癌（E错）最为常见。